女，36岁。右侧颈部淋巴结肿大1月余，左侧颈部淋巴结亦肿大伴发热1周。既往体健。查体：T38.1℃，双侧颈部可触及数个肿大淋巴结。左颈部淋巴结活检见淋巴结结构完全破坏，弥漫性大细胞浸润，免疫组化：CD20（+），CD30（-），CD5（-）。最可能的诊断是
A. 滤泡性淋巴瘤
B. 间变性大细胞淋巴瘤
C. 套细胞淋巴瘤
D. 弥漫性大B细胞淋巴瘤
E. 霍奇金淋巴瘤

正确答案：D。弥漫性大B细胞淋巴瘤

解析：患者青年女性，双侧颈部淋巴结肿大伴发热（淋巴结肿大是淋巴瘤共同的临床表现，淋巴瘤常有发热、乏力、瘙痒及消瘦等全身症状），淋巴结活检见淋巴结结构完全破坏，弥漫性大细胞浸润，免疫组化：CD20（+），CD30（-），CD5（-）（符合弥漫大B细胞淋巴瘤病理变化）提示最可能的诊断为弥漫性大B细胞淋巴瘤（D对）。滤泡性淋巴瘤（A错）组织学特征是有滤泡存在，外套区消失，细胞形态呈小至中等大小的生发中心细胞和大的无核裂母细胞组成，来源于B细胞，CD10⁺，bcl-6⁺，bcl-2⁺，伴t（14；18）；间变性大细胞淋巴瘤（B错）细胞常呈CD30⁺，免疫表型为T细胞型；套细胞淋巴瘤（C错）由小细胞组成的B淋巴细胞肿瘤，细胞呈CD20⁺，CD5⁺；霍奇金淋巴瘤（P584）（D错）典型的病理特征是R-S细胞，以经典霍奇金淋巴瘤为多见，常有CD20⁺、CD30⁺、CD15⁺ 。